甲药品批发企业按规定从本省某药品生产企业购进某化学药制剂，并建立购进记录。按照药品管理法的有关规定甲企业建立的药品购进记录的内容至少应当包括
A. 药品通用名称、生产厂商规格、剂型、有效期批号、购（销）货单位、购销货数量、购销价格、购销货日期
B. 药品名称、生产厂商、供货单位名称、价格、批号、数量
C. 药品名称、规格、购（销）货单位、购（销）货数量、购销价格
D. 药品商品名称、规格、剂型数量

正确答案：A。药品通用名称、生产厂商规格、剂型、有效期批号、购（销）货单位、购销货数量、购销价格、购销货日期

解析：本题考查的是采购药品质量管理和进货检查验收制度。甲药品批发企业按规定从本省某药品生产企业购进某化学药制剂，并建立购进记录。按照药品管理法的有关规定甲企业建立的药品购进记录的内容至少应当包括药品通用名称、生产厂商规格、剂型、有效期批号、购（销）货单位、购销货数量、购销价格、购销货日期（A对）。采购药品应有真实、完整的药品购进记录。药品购进记录必须注明药品的通用名称、剂型、规格、批号、有效期、生产厂商、供货单位、购货数量、购进价格、购货日期以及国务院药品监督管理部门规定的其他内容。从药品生产企业、药品批发企业采购药品时，供货企业开具的票据应标明供货单位名称、药品名称、生产厂商、批号、数量、价格（B错）等内容的销售凭证。对留存的资料和销售凭证和购进（验收）记录等，应当按规定保存至超过药品有效期1年，但不得少于3年。